有关筛检，错误的是
A. 筛检试验应费用低廉
B. 应能迅速出结果
C. 目的是早期发现罕见病病例
D. 检查对象为表面上无病的人
E. 筛检试验应对人体无害

正确答案：C。目的是早期发现罕见病病例

解析：筛检是早期发现疾病的有效手段，其目的是发现可疑患者，区分可疑患者与可能无病者，其对象是健康或无症状的患者（D对），筛检方法要求更简便、快速、价廉、损害小，易于操作和易被检查者接受（ABE对），被筛检的疾病或缺陷是当地重大的公共卫生问题（C错，为本题正确答案），即疾病的现患率或死亡率高，影响面广，不控制将会造成严重的后果。